糖尿病肾病多表现为
A. 血尿
B. 肾小球酸中毒
C. 白蛋白尿
D. 白细胞尿
E. 肾性糖尿

正确答案：C。白蛋白尿

解析：糖尿病的特异性并发症是微血管病变，肾脏中有大量微血管，在糖尿病患者中，微血管病变会引起肾小球病变，导致尿白蛋白排泄率增高，病人多表现为白蛋白尿（C对）。血尿（P460）（A错）多见于肾炎综合征和IgA肾病等。白细胞尿（P494）（D错）多见于泌尿系感染。肾性糖尿（P490）（E错）多见于肾间质疾病，肾小管损伤导致近端小管重吸收功能障碍，尿糖含量增高。